在抗感冒药中，含有伪麻黄碱成分复方制剂的应用目的是
A. 减轻鼻黏膜充血
B. 退热缓解疼痛
C. 对抗病毒复制
D. 改善体液循环
E. 减少打喷嚏或者鼻溢液

正确答案：A。减轻鼻黏膜充血

解析：本题考查抗感冒药复方制剂。在抗感冒药中，含有伪麻黄碱成分复方制剂的应用目的是减轻鼻黏膜充血（A对）。伪麻黄碱为鼻黏膜血管收缩药，可减轻鼻窦、鼻腔黏膜血管充血,解除鼻塞症状,有助于保持咽鼓管和窦口通畅。退热缓解疼痛（B错）的是解热镇痛药，如阿司匹林、对乙酰氨基酚。对抗病毒复制（C错）的成分是抗病毒药。改善体液循环（D错）的成分主要是蛋白水解酶。减少打喷嚏或者鼻溢液（E错）的成分是抗组胺药如氯苯那敏。